维A酸软膏治疗痤疮时，合理的用药是
A. 一日一次，睡前使用
B. 一日一次，晨起使用
C. 一日一次，固定时间使用
D. 一次二次，早、晚使用
E. 一日三次，早、中、晚使用

正确答案：A。一日一次，睡前使用

解析：本题考查维A酸的使用。维A酸软膏治疗痤疮时，合理的用药是一日一次，睡前使用（A对）。维A酸涂于患处，一日一次，睡前使用。一日量不应超过20g （乳膏或软膏剂）。